病变好发于直肠和乙状结肠的是
A. 肠结核
B. 大肠癌
C. 克罗恩病
D. 溃疡性结肠炎
E. 结核性腹膜炎

正确答案：D。溃疡性结肠炎

解析：溃疡性结肠炎病变好发于直肠和乙状结肠（D对）。肠结核（P368）（A错）好发于回盲部。大肠癌（P382）（B错）好发于直肠。克罗恩病（P377）（C错）好发于末段回肠。结核性腹膜炎（P370）（E错）可继发于肠道结核，是结核分枝杆菌引起的腹膜慢性弥漫性感染。